情志为病，过悲则
A. 气上
B. 气下
C. 气缓
D. 气结
E. 气消

正确答案：E。气消

解析：悲则气消，过度悲忧伤肺，导致肺气耗伤、肺失宣降，临床常见精神不振，意志消沉，胸闷气短，懒言乏力等症（E对）。怒则气上，过怒导致肝气疏泄太过，气机上逆，甚则血岁气逆、并走于上，临床可见头胀头痛，面红目赤，甚则呕血、昏厥卒倒等（A错）。恐则气下，过度恐惧伤肾，致使肾气不固、气陷于下，临床可见大恐引起的二便失禁，甚则遗精等症（B错）。喜则气缓，过度喜悦伤心，导致心气涣散不收，重者心气暴脱、神不守舍的病机变化，临床可见精神不集中，神志失常，狂乱，或见心气暴脱的大汗淋漓，气息微弱，脉微欲绝等症（C错）。思则气结，过度思虑伤脾，导致脾气结滞、云华失职，临床可见精神萎靡，反应迟钝，不思饮食，腹胀纳呆，便溏等症（D错）。